“同病异治”的依据是
A. 人是一个有机的整体
B. 人与自然的统一性
C. 相同的疾病出现不同的舌象、脉象
D. 相同的疾病出现不同的证候
E. 相同的疾病表现出不同的症状

正确答案：D。相同的疾病出现不同的证候

解析：本题考查的是同病异治的概念。“同病异治”的依据是相同的疾病出现不同的证候（D对）。“同病异治”，是指同一种疾病，由于发病的时间、地区及患者机体的反应不同，或处于不同的发展阶段，所表现的证不同，因而治法就各异。